含有橙皮苷的药材是
A. 紫衫
B. 葛根
C. 陈皮
D. 麻黄
E. 满山红

正确答案：C。陈皮

解析：本题考查的是陈皮的化学成分。含有橙皮苷的药材是陈皮（C对）。陈皮中除含挥发油外，还含有多种黄酮类化合物，其中橙皮苷多制成甲基橙皮苷供药用，是治疗冠心病药物“脉通”的重要原料之一。《中国药典》以橙皮苷为指标成分对陈皮进行含量测定。要求陈皮中橙皮苷含量不得少于3.5%；广陈皮中橙皮苷含量不得少于2.0%，对广陈皮，另外要求测定川陈皮素和橘皮素的总量，总量不得少于0.42%。紫衫（A错）的有效成分为萜类化合物。葛根（B错）含异黄酮类化合物，主要成分有大豆素、大豆苷、大豆素-7，4'-二葡萄糖苷及葛根素、葛根素-7-木糖苷。《中国药典》以葛根素为指标成分进行含量测定，要求含葛根素不得少于2.4%。麻黄（D错）中含有多种生物碱，以麻黄碱和伪麻黄碱为主，前者占总生物碱的40%～90%，《中国药典》以盐酸麻黄碱和盐酸伪麻黄碱为指标成分进行含量测定，要求药材和饮片含盐酸麻黄碱和盐酸伪麻黄碱的总量不得少于0.80%。此外麻黄还含少量的甲基麻黄碱、甲基伪麻黄碱和去甲基麻黄碱、去甲基伪麻黄碱。满山红（E错）叶中含有杜鹃素、8-去甲基杜鹃素、山柰酚、槲皮素、杨梅素、金丝桃苷、异金丝桃苷以及莨菪亭、伞形酮、木毒素、牻牛儿酮、薄荷醇、杜松脑和α-桉叶醇、β-桉叶醇、γ-桉叶醇等。其中杜鹃素为祛痰成分，临床用于治疗慢性支气管炎。《中国药典》以杜鹃素为对照品对满山红进行含量测定。要求杜鹃素含量不少于0.08%。